在正常情况下对人体有益无害，寄生于正常人体表及与外界相通的腔道中的微生物群是
A. 正常菌群
B. 微生态平衡
C. 机会致病菌
D. 菌群失调
E. 菌群失调症

正确答案：A。正常菌群

解析：正常菌群是寄生于正常人体表及与外界相通的腔道中的微生物群，包括细菌、真菌及一些病毒，在正常情况下对人体有益无害。掌握“细菌的分类”知识点。